用于治疗伤寒、副伤寒的首选药
A. 氯霉素
B. 青霉素
C. 羧苄青霉素
D. 四环素
E. 利福平

正确答案：A。氯霉素

解析：本题考查氯霉素。氯霉素（A对）为敏感菌株所致伤寒、副伤寒的首选药。青霉素（B错）适用于革兰阳性球菌所致的感染以及破伤风、气性坏疽、流行性脑脊髓膜炎、鼠咬热、梅毒、淋病。羧苄青霉素（C错）主要用于绿脓杆菌及部分变形杆菌、大肠杆菌所引起的炎症及感染。四环素（D错）高浓度时具杀菌作用，除了常见的革兰氏阳性菌、革兰氏阴性菌以及厌氧菌外，多数立克次体属、支原体属、衣原体属、非典型分枝杆菌属、螺旋体也对该品敏感。利福平（E错）对结核分枝杆菌和部分非结核分枝杆菌（包括麻风分枝杆菌等）在宿主细胞内外均有明显的杀菌作用。